链激酶用于治疗血栓性疾病，是由于其可
A. 扩张血管
B. 抑制凝血因子
C. 抑制血小板聚集
D. 促进纤溶酶原合成
E. 激活纤溶酶原

正确答案：E。激活纤溶酶原

解析：链霉素属于纤维蛋白溶解药，可与内源性纤维蛋白溶酶原结合成复合物而激活纤溶酶原（E对），并促使纤维蛋白酶原转变为纤溶酶，纤溶酶迅速水解血栓中纤维蛋白，导致血栓溶解，临床主要用于血栓栓塞性疾病。链激酶不具有扩张血管的作用（A错）。抗凝血药肝素等可与抗凝血酶Ⅲ结合，结合后使凝血酶Ⅲ构型发生变化，活性部位充分暴露，并迅速与凝血因子Ⅱa、Ⅸa、Ⅹa、Ⅺa等结合，并抑制这些因子（B错）产生抗凝作用。抗血小板药如阿司匹林等可抑制血小板内的COX-1，从而抑制血小板的合成和聚集（C错）。链激酶不能促进纤溶酶原的合成（D错）。